别嘌呤醇治疗痛风的机制是该药抑制
A. 黄嘌呤氧化酶
B. 腺苷脱氨酸
C. 尿酸氧化酶
D. 鸟嘌呤脱氢酶
E. 黄嘌呤脱氢酶

正确答案：A。黄嘌呤氧化酶